6┘表示
A. 左上颌第一前磨牙
B. 左上颌第二前磨牙
C. 左上颌第一磨牙
D. 右上颌第一前磨牙
E. 右上颌第一磨牙

正确答案：E。右上颌第一磨牙

解析：┘表示右上颌，6表示第一磨牙，故6┘表示右上颌第一磨牙(E对)。